下颌下腺导管口位于舌下区前部，主导管长
A. 1～2cm
B. 2～4mm
C. 5～7cm
D. 7～9cm
E. 9～12cm

正确答案：C。5～7cm

解析：本题考查唾液腺造影技术。下颌下腺导管口位于舌下区前部，主导管长5～7cm（C对）。下颌下腺导管口位于舌下区前部，主导管长5～7cm，管径2～4mm，由前上向后下方向走行。主导管走行至下颌角前约呈直角向下弯曲，腺体外形略呈梨形。副腺体大多数位于主导管下部。下颌下腺分支导管较少，且较短而粗。